用背俞穴治疗耳聋，应首选
A. 肺俞
B. 三焦俞
C. 肝俞
D. 肾俞
E. 脾俞

正确答案：D。肾俞

解析：肺俞主治：①咳嗽、气喘、咯血等肺疾②骨蒸潮热、盗汗等阴虚病证（A错）。三焦俞主治：①肠鸣、腹胀、呕吐、腹泻、痢疾等脾胃肠腑病证②小便不利、水肿等三焦气化不利病证③腰背强痛（B错）。肝俞主治：①胁痛、黄疸等肝胆病证②目赤、目视不明、夜盲、迎风流泪等目疾③癫狂痫④脊背痛（C痛）。肾俞【主治】①头晕、耳鸣、耳聋、腰酸痛等肾虚病证②遗尿、遗精、阳痿、早泄、不育等生殖泌尿系疾患③月经不调、带下、不孕等妇科病证（D对）。脾俞主治：①腹胀、纳呆、呕吐、腹泻、痢疾、便血、水肿等脾胃肠腑病证②背痛（E痛）。